对需氧革兰阴性菌具有抗菌活性，属于单酰胺类的抗菌药物是
A. 头孢吡肟
B. 头孢西丁
C. 拉氧头孢
D. 氨曲南
E. 美罗培南

正确答案：D。氨曲南

解析：本题考查氨曲南。对需氧革兰阴性菌具有抗菌活性，属于单酰胺类的抗菌药物是氨曲南（D对）。头孢吡肟（A错）对肠杆菌科细菌和铜绿假单胞菌的活性与头孢他啶大致相仿。头孢西丁（B错）对大多数超广谱β-内酰胺酶稳定，且对拟杆菌属等厌氧菌具有抗菌活性。拉氧头孢（C错）对多种革兰阴性菌及厌氧菌有较强作用，对β-内酰胺酶稳定。美罗培南（E错）对革兰阳性菌、革兰阴性菌、需氧菌、厌氧菌均有很强的抗菌活性。